男性，26岁，右侧腹股沟区发现可复性肿块4年，6小时前患者发现肿块突然增大、剧烈疼痛。查体：右侧腹股沟区有6cm×5cm椭圆形肿块，触痛明显，腹部无压痛、反跳痛、腹肌紧张。首选的有效治疗是
A. 禁食补液
B. 手法复位
C. 应用止痛或镇静剂
D. 急诊手术
E. 应用抗生素

正确答案：D。急诊手术

解析：青年男性患者，右侧腹股沟区可复性肿块4年，应诊断为右侧腹股沟疝，6小时前肿块突然增大、剧痛、触痛明显，提示腹股沟疝已发生嵌顿。由于嵌顿时间超过4小时，已错过手法复位（B错）的时机，因此首选的有效治疗是急诊手术（D对），以防止疝内容物坏死并解除伴发的肠梗阻；若术中发现嵌顿的肠管已绞窄坏死，则应切除坏死的肠管作肠吻合，同时行单纯疝囊高位结扎。禁食、补液（A错）为术前的准备措施；术前、术后常规应用抗生素（E错）可预防感染，减少并发症，两者均不是首选的治疗方法。止痛或镇静剂会掩盖患者的症状，延误病情，应禁用（C错）。